马尾
A. 由骶部脊神经后根所组成
B. 由下部脊神经后根所组成
C. 由下部脊神经前根所组成
D. 由腰、骶、尾部的脊神经根所组成
E. 存在于脊髓圆锥以上

正确答案：D。由腰、骶、尾部的脊神经根所组成

解析：马尾由腰、骶、尾部的脊神经根所组成（D对），位于脊髓圆锥以下（E错）。